肾病综合征引起水肿的最主要机制是
A. 血浆晶体渗透压降低
B. 毛细血管滤过压升高
C. 毛细血管通透性增高
D. 血浆胶体渗透压降低
E. 肾小球滤过率下降

正确答案：D。血浆胶体渗透压降低

解析：肾病综合征临床表现表现为大量蛋白尿、低蛋白血症、高度水肿、高脂血症。主要机制为肾小球基膜受损，血浆蛋白大量丢失，导致血浆胶体渗透压降低（D对），组织渗透压相对升高，水分由血浆进入组织，引发组织水肿。肾病综合征时，血浆晶体渗透压、毛细血管滤过压、毛细血管通透性、肾小球滤过率无明显变化（ABCE错）。